下列除哪项外，均属病理性黄疸
A. 生后24小时内出现
B. 黄疸10～14天左右消退
C. 黄疸退而复现
D. 黄疸持续加深
E. 黄疸3周后仍不消退

正确答案：B。黄疸10～14天左右消退

解析：凡具备以下其中任何一项者即可诊断为病理性黄疸：①黄疸出现时间过早，常在生后24小时内出现（A对）；②血清胆红素值过高或上升过快，血清胆红素足月儿>220μmol/L（12.9mg/L）、早产儿256.5>μmol/L（15mg/L），或每日上升超过85μmol/L（5mg/L）（D对）；③黄疸持续时间过长，足月儿>2周，早产儿>4周（E对）；④黄疸退而复现（C对）；⑤血清结合胆红素>34.2μmol/L（2mg/L）（B错，为本题正确答案）。